有关生物转化作用的描述，错误的是
A. 有些物质经过生物转化毒性增强
B. 肝是进行生物转化最重要的器官
C. 使非极性物质的极性增强
D. 作用的实质是裂解生物活性物质
E. 使疏水性物质水溶性增加

正确答案：D。作用的实质是裂解生物活性物质

解析：生物转化作用是机体在排出某些非营养物质之前，对它们进行代谢转变，使其水溶性提高，极性增强，从而易于通过胆汁或尿排出。肝是机体内生物转化最重要的器官（B对），皮肤、肺及肾等亦有一定的生物转化作用。生物转化作用的实质是使体内大部分非营养物质的生物学活性降低或丧失，或使有毒物质的毒性减低或消除，而不是直接裂解生物活性物质（D错，为本题正确答案）。但肝的生物转化作用不等于解毒作用，有些物质经过生物转化，虽然溶解性增加，其毒性反而增强（A对）。肝的生物作用包括两相反应，其中第一相反应包括氧化、还原、水解，许多物质通过第一相反应，其分子中的某些非极性基团转变为极性基团，可使非极性物质的极性增强（C对），使疏水性物质水溶性增加（E对），排出体外。